最能减少输血的并发症且无传染疾病危险的是
A. 输新鲜血
B. 输新鲜冰冻血浆
C. 输浓缩红细胞
D. 输白蛋白制剂
E. 自体输血

正确答案：E。自体输血

解析：自体输血是先收集病人自身的血液，在需要的时候进行回输，由于血液中不存在异体抗原，因此是最能减少输血并发症且无传染疾病危险（E对）。输新鲜血（A错）、输新鲜冰冻血浆（B错）、输浓缩红细胞（C错）和输白蛋白制剂（D错）都是异体输血，若操作不当，则有可能发生输血并发症或感染传染病。